《中华人民共和国传染病学防治法》明确规定的传染病学防治方针是
A. 分类管理
B. 控制为主
C. 防治结合
D. 预防为主
E. 依靠科学

正确答案：D。预防为主

解析：《中华人民共和国传染病学防治法》第二条 国家对传染病防治实行预防为主的方针（D对），防治结合（C错）、分类管理（A错）、依靠科学（E错）、依靠群众。